脂肪酸合成的原料乙酰CoA从线粒体转移至胞液的途径是
A. 三羧酸循环
B. 乳酸循环
C. 糖醛酸循环
D. 柠檬酸-丙酮酸循环
E. 丙氨酸-葡萄糖循环

正确答案：D。柠檬酸-丙酮酸循环